杏仁、麻黄配伍主要治疗
A. 喘咳
B. 水肿
C. 头痛
D. 表证
E. 痹症

正确答案：A。喘咳

解析：麻黄辛散，偏走于表，宣肺解表以平喘；杏仁苦降，偏于行里，佐麻黄散寒降气以平喘（A对）。两药相向，一升一降，一表一里，共使风寒去，肺气宣，逆气降，咳喘消。